介导Ⅰ型超敏反应的细胞是
A. CTL细胞
B. B细胞
C. NK细胞
D. 浆细胞
E. 肥大细胞

正确答案：E。肥大细胞

解析：Ⅰ型超敏反应在四型超敏反应中发生速度与最快，一般在第二次接触抗原后数分钟内出现临床症状，故也称速发型超敏反应。变应原是Ⅰ型超敏反的始动因素，肥大细胞（E对）和嗜碱性粒细胞表面表达高亲和性IgE Fc受体介导Ⅰ型超敏反发生。CTL细胞（A错）为细胞毒T淋巴细胞通过细胞毒作用特异性杀伤病毒等胞内感染病原体所感染的靶细胞和体内突变的细胞。B细胞（B错）通过抗体发挥特异性体液免疫功能，同时也是重要的抗原提呈细胞，并参与免疫调节。NK细胞（C错）杀伤靶细胞没有MHC限制性，以“自我丢失”识别模式识别病毒感染靶细胞和突变细胞。浆细胞（D错）又称抗体形成细胞，是B细胞分化的终末细胞，能合成和分泌特异性抗体，表面不再表达BCR和MHC Ⅱ类分子。